对口腔功能影响最大的疾病是
A. 后牙牙体缺损
B. 牙列缺损
C. 牙列缺失
D. 颞下颌关节紊乱病
E. 全牙列重度磨耗

正确答案：C。牙列缺失

解析：牙列缺失对患者的咀嚼功能、面容改变产生重大影响，是一种潜在的病理状态。随着时间的推移，可继而引起牙槽嵴、口腔黏膜、颞下颌关节、咀嚼肌及神经系统的有害改变。掌握“牙列缺失后的病因及影响”知识点。